胸部触诊语音震颤减弱的是
A. 肺脓肿
B. 肺梗死
C. 阻塞性肺气肿
D. 空洞型肺结核
E. 支气管肺炎

正确答案：C。阻塞性肺气肿

解析：语音震颤操作方法是：病人发出声音，音波产生的震动，沿着气管、支气管及肺泡，传到胸壁引起共鸣的震动，检查者用手触知，感受震颤变化。语音震颤的强弱取决于气管、支气管是否通畅，胸壁传导是否良好。支气管肺炎（E错）、肺梗死（B错）时，肺组织实变，传导良好，语颤增强。肺脓肿（A错）、空洞性肺结核（D错）时，肺内产生巨大空腔，声波在空腔产生共鸣，利于声波传导，语颤增强。阻塞性肺气肿时，肺内含气量增多，语颤传导受阻，语颤减弱（C对）。